药品费用控制方法不包括
A. 药品价格控制
B. 风险共担合同
C. 药物利用评价
D. 总量控制，结构调整
E. 扩大药物的适用范围

正确答案：E。扩大药物的适用范围